外邪侵袭，损伤脉络而引起出血，最为多见的邪气是
A. 风
B. 寒
C. 暑
D. 热
E. 燥

正确答案：D。热

解析：各种原因导致出血，其共同的病机可以归结为火热熏灼、迫血妄行及气虚不摄、血溢脉外两类。血本阴精，不宜动也，而动则为病。血主营气，不宜损也，而损则为病。盖动者多由于火，火盛则逼血妄行；损者多由于气，气伤则血无以存。其中属外邪的是火热，故（D对）（ABCE错）。